治疗肝阳偏亢，肝风上扰，头痛，眩晕，失眠者，应首选
A. 羚角钩藤汤
B. 天麻钩藤饮
C. 地黄饮子
D. 大定风珠
E. 镇肝熄风汤

正确答案：B。天麻钩藤饮

解析：治疗肝阳偏亢，肝风上扰，头痛，眩晕，失眠者。方用天麻钩藤饮，为治疗肝阳偏亢，肝风上扰的常用方。天麻、钩藤平肝息风，石决明平肝潜阳，除热明目；川牛膝引血下行，活血利水；杜仲桑寄生补益肝肾；栀子、黄芩清肝泻火；益母草活血利水，平肝潜阳；夜交藤、朱茯苓宁心安神（B对）。羚角钩藤汤为治疗肝经热盛动风的常用方（A错）。地黄饮子为治疗肾虚喑痱的常用方（C错）。大定风珠治温病后期，真阴大亏，虚风内动之常用方（D错）。镇肝息风汤为治疗类中风之常用方（E错）。